与躯干、四肢浅感觉传导无关的是
A. 脊神经节
B. 脊髓后角细胞
C. 内侧丘系
D. 脊髓丘系
E. 无

正确答案：C。内侧丘系

解析：浅感觉传导通路，由 3 级神经元组成，第1级神经元为脊神经节（A对）内假单极神经元，传导粗略触觉和压觉的纤维（粗纤维）经后根内侧部进入脊髓后索，其中包括脊髓后角细胞（B对），再终止于第 2 级神经元，第 2 级神经元胞体主要位于...组成脊髓丘脑侧束和脊髓丘脑前束，即脊髓丘系（D对）。薄束核、楔束核发出的纤维，弓形走向中央管腹侧，左、右交叉，称为内侧丘系交叉， 因交叉后的纤维在中线两侧上行成为内侧丘系（C错，为本题正确答案），其与躯干、四肢浅感觉传导无关。